具有吡嗪结构，有保钾排钠作用的药物是
A. 氢氯噻嗪
B. 氯噻酮
C. 乙酰唑胺
D. 螺内酯
E. 阿米洛利

正确答案：E。阿米洛利